人参养荣丸的功能是
A. 益气复脉
B. 益气固表
C. 养血调经
D. 温补气血
E. 解郁调经

正确答案：D。温补气血

解析：本题考查的是人参养荣丸的功能。人参养荣丸的功能是温补气血温补气血（D对）。人参养荣丸：【功能】温补气血。生脉饮：【功能】益气复脉（A错），养阴生津。固本咳喘片：【功能】益气固表（B错），健脾补肾。逍遥颗粒：【功能】疏肝健脾，养血调经（C错）。月季花：【功效】活血调经，疏肝解郁（E错）。